位于咽腔口部的结构是
A. 舌扁桃体
B. 腭扁桃体
C. 咽扁桃体
D. 咽隐窝
E. 梨状隐窝

正确答案：B。腭扁桃体

解析：位于咽腔口部的结构为腭扁桃体(B对)，舌扁桃体(A错)位于舌根背面，咽扁桃体(C错)、咽隐窝(D错)位于鼻咽部，梨状隐窝(E错)位于喉咽部。